卵巢上皮癌的常用化疗方案为
A. 顺铂+紫杉醇
B. 紫杉醇+卡铂
C. 顺铂+长春新碱+异环磷酰胺
D. 顺铂+长春新碱
E. 博来霉素+长春新碱

正确答案：B。紫杉醇+卡铂

解析：上皮性卵巢癌初次治疗原则是手术为主，辅以化疗、放疗等综合治疗。其对化疗较敏感，即使已有广泛转移也能取得一定疗效。除经过全面分期手术的ⅠA期和ⅠB期且为G1（高分化）的患者不需化疗外，其他患者均需化疗。多采用以铂类为基础的联合化疗方案，常用化疗方案有TC、TP和PC。TC方案包括紫杉醇（T）＋卡铂（C）（B对）。TP方案包括紫杉醇（T）＋顺铂（P）；PC方案包括顺铂（P）＋环磷酰胺（C）（本题出题不够严谨，AB均可，相对来说卡铂肾毒性相对比顺铂小，临床诊疗指南中选用TC，故答案B）。